18岁男性，右颌下区无痛性质软肿物发现三月，表面皮肤正常，口内检查亦未见异常。行颌下手术时见肿物呈囊性，术中囊壁破裂，流出黏稠而略带黄色蛋清样液体，遂将囊壁及颌下腺一并摘除，但术后不久囊肿复发。术前对诊断最有帮助的检查是
A. 颌下腺侧位片
B. 颌下腺造影
C. 舌下腺造影
D. 囊肿穿刺检查
E. B超检查

正确答案：D。囊肿穿刺检查

解析：本题考查穿刺检查。一般对触诊有波动感或非实质性含液体的肿块，可通过穿刺抽吸肿块内容物，了解内容物的颜色、透明度及粘稠度等性质，可进一步协助诊断，如舌下腺囊肿可以抽出蛋清样液体，因此行囊肿穿刺检查（D对）对诊断最有帮助。颌下腺侧位片（A错）通常用于拍摄下颌下腺结石，且此患者的病变部位在舌下腺，舌下腺位于下颌下腺的前上方，下颌下腺侧位片用于检查下颌下腺导管后部的唾液腺，故下颌下腺侧位片不能显示出舌下腺病变。唾液腺造影的适应症主要有唾液腺慢性炎症、舍格伦综合症、唾液腺良性肥大、唾液腺肿瘤、唾液腺涎瘘、唾液腺结实等，若已怀疑为舌下腺囊肿，一般不用唾液腺造影进行诊断，否则造影剂会破坏囊壁，使病变范围扩大，因此下颌下腺造影（B错）、舌下腺造影（C错）都不适合。B超检查（E错）通常用于检查是否有占位性病变，以及肿块是囊性还是实性等，没有穿刺检查明确可靠。